恒牙胚萌出时，在干燥的颅骨表面可以看到呈条索样的“引导管”，此结构中含有以下哪种上皮的剩余成分
A. 牙板
B. 口腔黏膜
C. 呼吸道黏膜
D. 消化道黏膜
E. 体表皮肤

正确答案：A。牙板

解析：当牙胚向（牙合）面方向萌出时，包绕牙胚的牙囊组织通过结缔组织条索与口腔黏膜固有层相连，有时内含有牙板的剩余上皮，这一结构称为引导索。在干燥的幼儿颅骨上，乳牙的舌侧可见含有结缔组织条索的孔，称为引导管。掌握“牙胚的发生及分化”知识点。